泪腺窝位于
A. 眶上壁前外侧部
B. 眶上壁前内侧部
C. 眶外侧壁前部
D. 眶内侧壁前上部
E. 无

正确答案：A。眶上壁前外侧部

解析：泪腺窝位于眶上壁前外侧部（A对）。眶外侧壁后部有眶上裂，向后通入颅中窝（C错）。